感染易发生骨髓炎甚至直接导致颅内感染的间隙是
A. 眶下间隙
B. 翼下颌间隙
C. 咬肌间隙
D. 下颌下间隙
E. 颞间隙感染

正确答案：E。颞间隙感染

解析：本题考查颞间隙感染。颞间隙感染（E对）易发生骨髓炎甚至直接导致颅内感染。眶下间隙感染（A错）可形成眶内蜂窝织炎、海绵窦血栓性静脉炎。翼下颌间隙感染（B错）可向邻近间隙扩散，形成颞下、咽旁、下颌下、颌后等多间隙感染。咬肌间隙感染（C错）可形成下颌支的边缘性骨髓炎。下颌下间隙感染（D错）早期表现为下颌下淋巴结炎，后扩散形成蜂窝织炎，易舌下间隙扩散。